角化的复层鳞状上皮中没有
A. 透明细胞
B. 角质细胞
C. 基底层
D. 中间层
E. 棘层

正确答案：D。中间层

解析：本题考查口腔黏膜上皮。角化的复层鳞状上皮中没有中间层（D错，为本题正确答案）。中间层为非角化上皮的结构。角化的复层鳞状上皮主要由角质细胞（B对）构成，该细胞由深层至表面依次是基底层（C对）、棘层（E对）、颗粒层、角化层。在颗粒层，胞质内含嗜碱性透明（A对）角质颗粒，染色深，胞核浓缩，有利于细胞内钙的储存。